以下关于房室结的叙述何者正确
A. 位于上腔静脉与右心房交界处心内膜深面
B. 位于房间隔下部,冠状窦口前上方心内膜深面
C. 位于房间隔下部,冠状窦口后方心内膜深面
D. 为心室收缩的起博点
E. 发出结间束至窦房结

正确答案：B。位于房间隔下部,冠状窦口前上方心内膜深面

解析：位于房间隔下部, 冠状窦口前上方心内膜深面（B对）为房室结，其尖对着膜性室间隔的房室部。